多由急性化脓性根尖周炎及根尖周脓肿引起的骨髓炎是
A. 慢性颌骨骨髓炎
B. 急性中央性颌骨骨髓炎
C. 放射性颌骨骨髓炎
D. 边缘性颌骨骨髓炎
E. 婴儿颌骨骨髓炎

正确答案：B。急性中央性颌骨骨髓炎

解析：中央性颌骨骨髓炎多在急性化脓性根尖周炎及根尖周脓肿的基础上发生。炎症先在骨髓腔内发展，再由颌骨中央向外扩散，可累及骨密质及骨膜。化脓性中央颌骨骨髓炎，绝大多数发生在下颌骨，这与颌骨局部解剖有密切关系。掌握“颌骨骨髓炎”知识点。